患者王某，15岁，因患感冒、咳嗽，到社区卫生服务中心就诊，经问诊结合血常规检查结果，医师开具了左氧氟沙星片、复方磷酸可特因口服溶液、感冒清热颗粒（外包装为红色OTC标识）的处方。药师审方后，认为左氧氟沙星片不宜用于18岁以下小儿及青少年，建议调整抗菌药物，改用阿奇霉素片。取药时，药师交代用药注意事项。收到复方磷酸可待因口服溶液的申请后，所在地省级市场监督管理部门的做法，正确的是
A. 予以批准，并告知只能在有关部门指定的医学、药学专业刊物上发布广告
B. 予以批准，并告知可以在大众媒体上发布广告
C. 不论其广告申请材料是否完备，均不予受理
D. 告知无须批准，经备案即可发布广告

正确答案：C。不论其广告申请材料是否完备，均不予受理

解析：本题考查不得发布广告的产品。说法正确的是不论其广告申请材料是否完备，均不予受理（C对）。不得发布广告的产品：按照规定，不得做广告的产品包括：麻醉药品、精神药品、医疗用毒性药品、放射性药品、药品类易制毒化学品，以及戒毒治疗的药品、医疗器械。对按处方药管理的含麻黄碱类复方制剂，其广告只能在医学、药学专业刊物上发布（A错）；不得在大众传播媒介发布广告或者以其他方式进行以公众为对象的广告宣传。广告管理：“双跨”药品作为“处方药”时不得在大众媒介上发布广告或者以其他方式进行以公众为对象的广告宣传，作为“非处方药”则可以在大众媒介上进行广告宣传（B错）。